某患者左肾结核无功能，右肾轻度积水，功能正常，经抗结核治疗仍有膀胱刺激症状。下步治疗方案为
A. 继续抗结核治疗
B. 加强支持疗法
C. 左肾切除术
D. 右肾造瘘术
E. 对症治疗

正确答案：C。左肾切除术

解析：患者左肾结核无功能，右肾功能正常，下一步首选的治疗方案为左肾切除术（C对）。患者经抗结核治疗仍有膀胱刺激症状，提示有膀胱挛缩，继续抗结核治疗（A错）、加强支持疗法（B错）及对症治疗（E错）对患者的病情改善意义不大。肾造瘘术（D错）适用于肾结核丧失功能、对侧严重肾积水且肾功能代偿不良的患者。